严重损伤引起DIC的主要机制是：
A. 交感神经兴奋，血浆儿茶酚胺水平增高
B. 大量红细胞和血小板受损
C. 继发于创伤性休克
D. 组织因子（FIII）大量入血
E. 清除活化凝血因子的功能受损

正确答案：D。组织因子（FIII）大量入血

解析：严重损伤，组织因子（FIII）大量入血（D对ABCE错），激活外源性凝血系统，启动凝血过程，引起DIC。